某县医院因收治多例人感染高致病性禽流感患者未按规定报告受到行政处罚。为此，该医院积极整改，加强《传染病防治法》的宣传，并落实各项传染病防治任务，不属于医院应承担的任务是
A. 开展流行病学调查
B. 承担责任区域内传染病预防工作
C. 承担医疗活动中与医院感染有关的威胁因素检测
D. 防止传染病的医源性感染
E. 防止传染病的医院感染

正确答案：A。开展流行病学调查

解析：开展流行病学调査（A错，为本题正确答案）属于疾病预防控制机构的责任。传染病防治的过程中医院的应承担的责任包括：与医疗救治有关的传染病防治工作和责任区域内的传染病预防工作（B对）；严格执行国务院卫生行政部门规定的管理制度、操作规范，防止传染病的医源性感染（D对）和医院感染（E对）；承担传染病疫情报告、本单位的传染病预防、控制以及责任区域内的传染病预防工作；承担医疗活动中与医院感染有关的危险因素监测（C对）、安全防护、消毒、隔离和医疗废物处置工作。